正确描述肺的是
A. 位于胸膜腔内
B. 右肺分3叶，有主动脉压迹
C. 左肺分2叶，有奇静脉压迹
D. 肺尖向上由胸廓上口突到颈根部
E. 用力深吸气时可充满肋膈隐窝

正确答案：D。肺尖向上由胸廓上口突到颈根部

解析：肺位于胸腔内（A错）。左肺有主动脉压迹（B错）。右肺有奇静脉压迹（C错）。肺尖向上由胸廓上口突到颈根部（D对）。即使在深吸气时，肺缘也达不到肋隔隐窝内（E错）。